主动-被动型的医患关系主要用于
A. 焦虑障碍患者
B. 康复期治疗患者
C. 严重昏迷的患者
D. 慢性感染患者
E. 急性感染期患者

正确答案：C。严重昏迷的患者

解析：医患关系分为三种类型：主动-被动型、指导-合作型、共同参与型。主动-被动型指医师主动命令，病人被动服从，适合难以表述自己主观意见的病人，如麻醉、严重昏迷的患者（C对）等。共同参与型指医患双方共同制定并实施诊断方案，适合慢性疾病病人，如慢性感染患者（D错）和心理疾病病人，如焦虑障碍患者（A错）。指导-合作型是指在医疗活动中，医患双方具有一定的主动性，但仍以医务人员为主，适合于急性感染期患者（E错）。